《灵枢·本脏》“分肉解利，皮肤调柔，腠理致密”，主要取决于
A. 宗气充盛
B. 元气充盛
C. 营卫调和
D. 卫气和利
E. 营气和利

正确答案：D。卫气和利

解析：卫气具有①护卫肌表，防御外邪。②卫气布散全身，发挥其温养作用，以维持脏腑肌肤的生理活动。③卫气司汗孔开合，调节汗液排泄，能维持体温的相对恒定（D对）。宗气的生理功能是行呼吸和气血（A错）；元气的生理功能是推动人体的生殖、生长发育和决定体质类型、抗病能力以及推动和调节各脏腑、经络、形体、官窍的生理活动（B错）；营卫二气相伴而行，协调内外阴阳，调节腠理开合和体温变化（C错）；营气的生理功能是化生血液和营养全身（E错）。